以下预防小儿急性呼吸道感染措施中错误的是
A. 保证母乳喂养
B. 及时添加辅食
C. 预防性使用抗生素
D. 保持室内空气新鲜
E. 多做户外活动

正确答案：C。预防性使用抗生素